女，30岁，发热3天，晕厥1次，心电图显示三度房室传导阻滞，心室率40次/分，治疗首选
A. 临时心脏起搏器植入
B. 肾上腺素
C. 直流电复律
D. 毛花甙丙（西地兰）
E. 阿托品

正确答案：A。临时心脏起搏器植入

解析：患者青年女性，发热伴晕厥1次，心电图示三度房室传导阻滞，心室率40次/分（正常值60～100次/分，显著缓慢而规律），此时治疗首选临时心脏起搏器植入（A对）。对于房室传导阻滞的患者多可静脉滴注异丙肾上腺素治疗，而肾上腺素（B错）常用于治疗过敏性休克和心脏骤停。直流电复律（P208）（C错）主要适用于各种严重的、甚至危及生命的恶性心律失常以及各种持续时间较长的快速型心律失常。毛花甙丙（西地兰）（D错）最适合用于有快速心室率的心房颤动并心室扩大伴左心室收缩功能不全者（P175），多用于急性左心衰竭的强心治疗。阿托品（P203）（E错）可提高房室阻滞的心率，适用于阻滞位于房室结的患者，但仅适用于无心脏起搏条件的应急情况。